下列哪项不是闭经气血虚弱证的主要症状
A. 月经闭止，腰膝酸软
B. 月经量少，经色淡质稀，继而停经
C. 头晕眼花
D. 神疲乏力
E. 食欲不振

正确答案：A。月经闭止，腰膝酸软

解析：闭经气血虚弱证的主要因为气血生化乏源，不能荣养充盈胞脉，故月经周期延后，量少； 血虚赤色不足，精微不充故色淡、质稀，渐致闭经（B对），气血亏虚不能营养机体，故神疲肢倦（D对）； 血虚不能上荣于头目，故头晕眼花（C对）； 气血不养心神故心悸气短； 气血生化不足，脾胃功能减退，故食欲不振（E对），面色萎黄，唇色淡红；舌质淡，苔少或薄白，脉沉缓或细弱均为气血虚弱之症。月经闭止，腰膝酸软（A错，为本题正确答案）属于肝肾不足证。